产生人绒毛膜促性腺激素的主要部位是
A. 胎膜
B. 卵巢黄体
C. 叶状绒毛膜
D. 胎儿胎盘单位
E. 胎盘合体滋养细胞

正确答案：E。胎盘合体滋养细胞